对诊断系统性红斑狼疮最有意义的检查是
A. 免疫球蛋白测定
B. 抗核抗体
C. 总补体溶血活力测定
D. E玫瑰花环试验
E. 淋巴细胞转化试验

正确答案：B。抗核抗体

解析：系统性红斑狼疮是一种多发于青年女性的累及多脏器的自身免疫性炎症性结缔组织病，其抗核抗体（B对）阳性率达96%，也可出现在类风湿性关节炎、皮肌炎、系统性硬化病、干燥综合征、慢性肝炎等，但滴度较低。免疫球蛋白测定（A错）增高多见于慢性感染、慢性肝病、肝癌、淋巴瘤及系统性红斑狼疮、类风湿性关节炎等自身免疫性疾病。总补体溶血活力测定（C错）减低多见于血清病、链球菌感染所致的肾小球肾炎、系统性红斑狼疮、自身免疫性溶血性贫血、类风湿性关节炎等。E玫瑰花环试验（D错）、淋巴细胞转化试验（E错）在临床上常作为测定人体细胞免疫功能的指标之一。